柯萨可夫综合征的临床特点是
A. 近记忆缺损，常有虚构和错构
B. 即刻记忆障碍、意识障碍、认识障碍
C. 震颤谵妄、痴呆状态、人格改变
D. 意识清晰情况下出现嫉妒与被害妄想
E. 突然停止饮酒后出现丰富鲜明幻觉

正确答案：A。近记忆缺损，常有虚构和错构